易发生神经损伤的是
A. 肱骨髁上骨折
B. 股骨颈骨折
C. 股骨干骨折
D. 腓骨上段骨折
E. 胫骨下1/3骨折

正确答案：A。肱骨髁上骨折

解析：肱骨髁上骨折，若发生内侧方移位，可损伤肱骨内上髁后侧尺神经沟内的尺神经，导致尺神经支配的肌肉及感觉功能障碍；若发生外侧方移位，可损伤桡神经，导致桡神经支配的肌肉及感觉功能障碍（A对）。股骨颈骨折（B错）易损伤动脉，导致股骨头缺血坏死。股骨干骨折（C错）可分为上1/3、中1/3和下1/3骨折，下1/3骨折可能会损伤腘动脉、腘静脉和胫神经、腓总神经。腓骨上段骨折（D错）不易发生神经损伤。胫骨下1/3骨折（E错）易损伤营养动脉，使血液循环减少，发生延迟愈合或不愈合。